有关乳牙龋坏的影响，说法不正确的是
A. 咀嚼功能的下降
B. 邻牙的倾斜移位
C. 继承恒牙的异位萌出
D. 全身感染性疾病
E. 导致骨折

正确答案：E。导致骨折

解析：乳牙的龋坏：局部的影响主要表现为咀嚼功能的下降和邻牙的倾斜移位，继承恒牙的异位萌出；全身影响主要为当乳牙龋严重时，感染引起的全身性疾病，如急性牙髓炎发展成急性蜂窝织炎，造成急性败血症；慢性根尖周炎形成感染病灶，引起全身免疫性疾病，如肾炎、血小板减少性紫癜、风湿病及蛛网膜炎等。掌握“学龄儿童口腔保健”知识点。